患者，男性，28岁。右上后牙近几日咬合痛不能咀嚼，检查发现17近中邻面龋坏，叩(+++)，松动Ⅲ度，冷热诊(-)，探诊(-)，患牙牙龈红肿、移行沟变平，患者痛苦面容，可能的诊断是
A. 根尖周脓肿
B. 骨膜下脓肿
C. 黏膜下脓肿
D. 急性根尖周炎浆液期
E. 急性牙髓炎

正确答案：B。骨膜下脓肿

解析：本题考查根尖周炎。患者右上后牙近几日咬合痛不能咀嚼，检查发现17近中邻面龋坏，叩(+++)，松动Ⅲ度，冷热诊(-)（E错），探诊(-)患牙牙龈红肿、移行沟变平，患者痛苦面容，可能的诊断是骨膜下脓肿（B对）。骨膜下脓肿检查：1)患者有痛苦面容，精神疲惫。体温可有升高，约38℃。末梢血象白细胞增多，计数多在10000～12000/mm³。患牙所属区域的淋巴结可出现肿大和扪痛。2)患牙叩痛(+++)，松动Ⅲ度，牙跟红肿，移行沟变平，有明显的压痛，扪诊深部有波动感。3) 严重的病例可在相应的颌面部出现蜂窝织炎，表现为软组织肿胀、压痛，致使面容改变。根尖周脓肿（A错）检查：①患牙叩痛(++)～(+++)，松动度Ⅱ～Ⅲ；②根尖部牙龈潮红，但尚无明显肿胀，扪诊感轻微疼痛；③相应的下颌下淋巴结或颏下淋巴结可有肿大及压痛。黏膜下脓肿（C错）：自发性胀痛及咬合痛也随之减轻，全身症状缓解。检查：1)患牙叩痛(+)～(++)，松动I度。2)根尖区黏膜的肿胀己局限，呈半球形隆起，扪诊时，波动感明显，脓肿较表浅而易破溃。急性根尖周炎浆液期（D错）：叩痛(+)～(++)，扪压患牙根尖部位出现不适或疼痛。牙龈尚无明显异常。患牙可有I度松动。X线检查根尖周组织影像无明显异常表现。